能够发挥切割功能的颌位是
A. 后退接触位
B. 侧颌颌位
C. 下颌姿势位
D. 前伸（牙合）颌位
E. 牙尖交错位

正确答案：D。前伸（牙合）颌位

解析：本题考查颌位。能够发挥切割功能的颌位是前伸（牙合）颌位（D对）。前伸（牙合）颌位指下颌相对于上颌位于ICP前方的下颌位置。比较稳定的前伸拾颌位包括对刃颌位及最大前伸颌位。（1）对刃颌位指下颌向前运动到上、下颌前牙切缘相对时下颌的位置，它是前牙咬切食物时下颌的一个功能性位置，下颌切牙自切缘相对滑回ICP的过程，为前牙发挥咬切功能的阶段。对于自然牙列，正常情况下，应当是前牙接触，后牙不接触或轻接触。（2）最大前伸颌位指下颌前伸至最大前伸位并保持咬合接触时的颌位，此时只有后牙接触，前牙不接触。